根据《国家药品监督管理局关于药品信息化追溯体系建设的指导意见》和《药品信息化追溯体系建设导则》，承担建设药品追溯协同平台责任的是
A. 药品上市许可持有人
B. 药品使用单位
C. 药品经营单位
D. 国家药品监督管理部门

正确答案：D。国家药品监督管理部门

解析：本题考查中华人民共和国药品管理法的总则。第十二条国家建立健全药品追溯制度。国务院药品监督管理部门（D对）应当制定统一的药品追溯标准和规范，推进药品追溯信息互通互享，实现药品可追溯。药品上市许可持有人（A错）和生产企业承担药品追溯系统建设的主要责任，药品经营企业和使用单位应当配合药品上市许可持有人和生产企业，建成完整药品追溯系统，履行各自追溯责任。药品经营企业（C错）和药品使用单位（B错）应配合药品上市许可持有人和生产企业建设追溯系统，并将相应追溯信息上传到追溯系统。